有关左颈总动脉的描述，正确的是
A. 发自头臂干
B. 沿气管前方上行
C. 行于颈内静脉外侧
D. 平环状软骨上缘分为颈内、外动脉
E. 与迷走神经、颈内静脉伴行于颈动脉鞘

正确答案：E。与迷走神经、颈内静脉伴行于颈动脉鞘

解析：左颈总动脉起自主动脉弓（A错），右颈总动脉起自头臂干。沿食管、气管和喉的外侧（B错）上行。平甲状软骨（D错）上缘分为颈内、外动脉。左颈总动脉与迷走神经、颈内静脉伴行于颈动脉鞘（E对）。